患者，女，29岁。G2P2，诊断为葡萄胎。查体：子宫如16周妊娠大小。肺部CT无异常。该患者治疗方法宜采用
A. 清宫术
B. 子宫全切术
C. 先清宫后手术切除子宫
D. 清宫后化疗
E. 化疗

正确答案：A。清宫术

解析：患者，女，29岁，葡萄胎诊断明确。葡萄胎诊断一经成立，应立即行清宫术（A对）。此患者肺部CT无异常，表明肿瘤无转移迹象，属于良性病变，且该患者处于生育年龄，故不选用子宫全切术（B错）及先清宫后手术切除子宫（C错）。清宫后化疗（D错）及化疗（E错）不常规推荐，仅用于有高危因素和随访困难的完全性葡萄胎患者。